下列哪项不是天癸成熟的条件
A. 肾气充盛
B. 脾气健旺
C. 已18岁
D. 精血充实
E. 肾阴充盛

正确答案：C。已18岁

解析：女子二七而天癸至，任脉通，太冲脉盛，月事以时下，故有子。丈夫二八，肾气盛，天癸至，精气溢泻，阴阳和，故能有子（C对）。肾藏精，具有生成、贮藏和施泻精气的功能。精藏于肾，依赖于肾气的贮藏作用和施泻作用发挥其主生殖的生理功能。如肾气盛，天癸至，月经来潮（A错）。脾胃为后天之本，气血生化之源。脾气健运，血循常道，血旺则精调（B错）。在月经的产生中，肝血下注冲脉，司血海之定期蓄溢，参与月经周期、经期、及经量的调节。肾藏精，肝藏血，精血同源而互生，同为月经的物质基础，精血充盛，则血海满溢，月事乃下（D错）。《精血全书·命门叙》说：“命门为精血之海…为元气之根。…五脏之阴气，非此不能滋；五脏之阳气，非此不能发。”肾气调节机体的代谢和生理功能活动，是通过肾中阴阳来实现的，天癸的产生依赖于肾阴阳的平衡协调（E错）。